下列属于阴道的特征的是
A. 孕育胚胎
B. 产生月经
C. 内分泌功能
D. 性交器官
E. 输送受精卵

正确答案：D。性交器官

解析：阴道是性交器官（D对），也是经血排出及胎儿娩出的通道。孕育胚胎（A错）、产生月经（B错）是子宫的特征。内分泌功能（C错）是卵巢的特征。输送受精卵（E错）是输卵管的特征。